属于M胆碱受体阻断剂，由于起效慢，适用于慢性阻塞性肺病维持治疗，且每日给药一次的是
A. 沙丁胺醇
B. 沙美特罗
C. 异丙托溴铵
D. 多索茶碱
E. 噻托溴铵

正确答案：C。异丙托溴铵